常与乙醇、丙二醇、注射用水组成注射液的混合溶剂，由于黏度和刺激性较大，不单独作注射剂溶剂用的是
A. PEG6000
B. 聚山梨酯20
C. 甘油
D. 注射用油
E. 二甲基亚砜

正确答案：C。甘油

解析：本题考查注射剂的溶剂。甘油（C对）与水或醇可任意混溶，但在挥发油和脂肪油中不溶，由于黏度和刺激性较大，不单独作注射剂溶剂用。